附子与干姜配伍后除湿助脾阳外，又善
A. 温肺化饮
B. 回阳救逆
C. 温肾助阳
D. 散寒通脉
E. 降逆止呕

正确答案：B。回阳救逆

解析：本题考查的是附子的配伍。附子与干姜配伍后除湿助脾阳外，又善回阳救逆（B对）。附子：【配伍】附子配干姜：附子辛热，功善回阳救逆、温助脾阳；干姜辛热，重在温中，兼能回阳。两药相配，回阳救逆及温中之力大增，治亡阳证及中焦寒证效佳。附子配细辛、麻黄：附子辛热，善补阳散寒；细辛辛温气烈，善祛少阴经风寒；麻黄辛温，善开腠里而发汗散寒。三药相配，善补阳发表散寒，治阳虚外感风寒功著。细辛：【配伍】细辛配干姜、五味子：细辛辛温，祛风散寒、温肺化饮；干姜辛热，温中散寒、温肺化饮（A错）；五味子酸温，敛肺气、滋肾阴。三药相配，主温燥兼敛润，善温肺化饮，且不耗气伤阴，治寒饮喘咳日久者效佳。丁香：【功效】温中降逆，温肾助阳（C错）。肉桂：【功效】补火助阳，引火归元，散寒止痛，温通经脉（D错）。旋覆花：【配伍】旋覆花配赭石：旋覆花苦降辛散，微温咸软，功善降逆止呕（E错）、降气化痰；赭石重镇潜降，苦寒清泄，功善镇潜平肝降逆。两药相配，寒温并用，降肺胃之逆气力强，治气逆呕恶、喘息效佳。